肾性急性肾衰竭的发生机制中下列哪--项不存在
A. 肾血管收缩
B. 肾血流灌注压降低
C. 肾小管阻塞
D. 原尿返漏
E. 肾髓质缺血。

正确答案：E。肾髓质缺血。

解析：肾性急性肾衰竭的发生机制包括：1.肾血管及血流动力学异常，①肾灌注压降低（B对）；②肾血管收缩（A对）；③肾毛细血管内皮细胞肿胀；④肾血管内凝血。2.肾小管损伤，①肾小管阻塞（C对）；②原尿返漏（D对）；③管－球反馈机制失调；3.肾小球滤过系数降低。